根据《处方管理办法》，关于处方书写规则的说法，错误的是
A. 药品用法可以用规范的中文英文书写，不得使用其他语言或缩写体
B. 每张处方只限一名患者用药，字迹清楚，不得涂改
C. 药品名称应当用规范的中文名称书写，没有中文名称的可以用规范的英文名称书写
D. 药品用法用量应当按照药品说明书规定的常规用法用量使用，特殊情况需要超剂量使用时，应当注明原因并再次签名

正确答案：A。药品用法可以用规范的中文英文书写，不得使用其他语言或缩写体

解析：本题考查处方书写。书写药品名称、剂量、规格、用法、用量要准确规范，药品用法可用规范的中文、英文、拉丁文或者缩写体书写（A错，为本题正确答案），但不得使用“遵医嘱”“自用”等含糊不清字句。每张处方限于一名患者的用药。处方应当字迹清楚，不得涂改（B对）。药品名称应当使用规范的中文名称书写，没有中文名称的可以使用规范的英文名称书写（C对）。药品用法用量应当按照药品说明书规定的常规用法用量使用，特殊情况需要超剂量使用时，应当注明原因并再次签名（D对）。